32岁，妇女，不规则阴道出血半年，妇查：阴道内可扪及自宫颈口脱出的4cm×5cm肿物，最适宜的处理
A. 推至宫腔内后，立即开腹切除子宫
B. 经阴道摘除送病理检查
C. 抗感染，待其自然还纳
D. 行开腹探查术
E. 行分段诊刮送病理检查

正确答案：B。经阴道摘除送病理检查

解析：本例高度怀疑黏膜下子宫肌瘤，但首先需要明确肿物的性质，才能决定是否需要切除子宫。而分段诊刮主要用于子宫内膜癌的诊断。掌握“子宫肌瘤”知识点。